/L，尿蛋白（+++）不必要的处理是
A. 应用糖皮质激素
B. 纠正酸中毒
C. 应用抗病毒药
D. 快速补充血容量
E. 静脉滴注青霉素

正确答案：E。静脉滴注青霉素

解析：45岁男性，发热3天（肾综合征出血热发热期全身中毒症状），少尿1天（肾综合征出血热少尿期），于12月15日入院（肾综合征出血热高发季节）；查体：BP60/30mmHg（血压低），神志清，球结膜充血、水肿，双腋下有出血点（毛细血管损害征），实验室检查：WBC25×10⁹/L（成人正常参考值4～10×10⁹/L），plt50×10⁹/L（100～300×10⁹/L），尿蛋白（+++）（肾损害），根据患者的临床表现和实验室结果，最可能的诊断是肾综合征出血热，患者血压60/30mmHg，已进入低血压休克期，根据患者的临床表现和实验室结果，应该尽早应用抗病毒药（C对），积极补充血容量（D对）、注意纠正酸中毒（B对）、改善微循环，可应用糖皮质激素（A对）。肾综合征出血热汉坦病毒感染，青霉素（E错，为本题正确答案）是抗细菌药物。